主要作用机制为控制支气管哮喘气道炎症的药物是
A. H₁受体拮抗剂
B. 长效β₂受体激动剂
C. M受体拮抗剂
D. 白三烯受体调节剂
E. 茶碱

正确答案：D。白三烯受体调节剂

解析：哮喘治疗药物分为控制性药物和缓解性药物，前者主要用于治疗气道慢性炎症，使哮喘维持临床控制，亦称抗炎药，后者指哮喘急性发作是用于迅速解除支气管痉挛从而缓解哮喘症状，亦称平喘药。白三烯受体调节剂和H₁受体拮抗剂属于控制性药物，其余均为缓解性药物。白三烯受体调节剂属于控制性药物（D对）通过调节白三烯的生物活性而发挥抗炎作用，同时可以舒张支气管平滑肌，是目前除吸入型糖皮质激素外唯一可单独应用的哮喘控制性药物。H1受体拮抗剂（A错）以其对细胞上组胺受体位点的可逆性竞争作用而阻止组胺作用于靶细胞，通过阻滞和拮抗H1受体而发挥抗过敏作用，但临床应用较少。长效β₂受体激动剂（B错）作用机制为激动气道的长效β₂肾上腺素受体，激活腺苷酸环化酶，减少肥大细胞和嗜碱性粒细胞脱颗粒和介质的释放，从而舒张支气管，缓解哮喘症状。M受体拮抗剂（C错）通过阻断节后迷走神经通路，降低迷走神经张力而起到舒张支气管、减少黏膜液分泌的作用。茶碱（E错）通过抑制磷酸二酯酶，提高平滑肌细胞内环苷腺酸（cAMP）浓度，拮抗腺苷受体，增强呼吸肌力量及增强气道纤毛清除功能等，从而舒张支气管缓解哮喘。